蛇肚疔切开时，应在
A. 患指侧面横切口
B. 患指侧面纵切口，不超过关节
C. 指端掌面纵切口
D. 指端侧面纵切口
E. 沿指腹弧形切口

正确答案：B。患指侧面纵切口，不超过关节

解析：手足部疔疮溃脓期的外治疗法：蛇眼疔宜沿甲旁0.2cm挑开引流。蛇头疔宜在指掌面一侧做纵形切口（C错），务必引流通畅，必要时可对口引流，不可在指掌面正中切开。蛇肚疔宜在手指侧面做纵形切口（A错），切口长度不得超过上下指关节面（B对）；关节区附近的脓肿切口尽量避免越过关节，若为关节区脓肿，一般施行横切口、弧形切口（DE错）或“S”形切口，因为纵切口在疤痕形成后易影响关节功能。